人体试验的道德原则，下列除外哪一项均正确
A. 知情同意原则
B. 控制风险原则
C. 保护隐私原则
D. 医学发展至上
E. 特殊保护原则

正确答案：D。医学发展至上

解析：我国《办法》将涉及人的生物医学研究应该遵循的伦理问题原则具体化为以下六个方面：知情同意原则；控制风险原则；免费和补偿原则；保护隐私原则；依法赔偿原则；特殊保护原则。掌握“涉及人和动物的医学实验伦理”知识点。